不属于抗乙型肝炎病毒的药品是
A. 拉米夫定
B. 恩替卡韦
C. 泛昔洛韦
D. 干扰素
E. 阿德福韦酯

正确答案：C。泛昔洛韦

解析：本题考查抗乙肝病毒药。不属于抗乙型肝炎病毒的药品是泛昔洛韦（C错，为本题正确答案）。泛昔洛韦是抗疱疹病毒药。抗乙型肝炎病毒药有拉米夫定（A对）、恩替卡韦（B对）、干扰素（D对）、阿德福韦酯（E对）等。